治疗中风半身不遂，脉络瘀阻证，应首选
A. 补阳还五汤
B. 血府逐瘀汤
C. 镇肝熄风汤
D. 地黄饮子
E. 牵正散

正确答案：A。补阳还五汤

解析：补阳还五汤重用生黄芪补益元气为君，当归尾活血通络而不伤血，赤芍、川芎、 桃仁、红花协同当归尾以活血祛瘀；地龙通经活络，力专善走，周行全身，全方共奏补气，活血，通络之功，故最宜治疗脉络瘀阻证（A对）。血府逐瘀汤功能祛瘀通脉，行气止痛，为治疗胸痹心血瘀阻证的选方（B错）。镇肝熄风汤功能补肝肾之阴，又能息风潜阳，为治疗中风中经络阴虚风动证的选方（C错）。地黄饮子功能滋肾阴，补肾阳，开窍化痰，为治疗中风恢复期肝肾亏虚证的选方（D错）。牵正散功能祛风化痰，通络止痉，为治疗中风后遗症口眼斜证的选方，（第五版教材P212）（E错）。